男，42岁。经健康危险因素评价得到评价年龄为50岁，增长年龄为49岁，则可以认为该男性的健康状况
A. 未出现健康危险因素
B. 未出现致病因素
C. 属于健康型
D. 属于自创性危险因素类型
E. 很可能存在难以改变的健康危险因素

正确答案：E。很可能存在难以改变的健康危险因素